检测血清中一种微量的小分子肽，下列方法中最敏感的是
A. 免疫荧光技术
B. 放射免疫分析法
C. 双向琼脂扩散法
D. 单向琼脂扩散法
E. 对流免疫电泳

正确答案：B。放射免疫分析法

解析：放射免疫测定法（B对）是用放射性核素标记抗原或抗体进行的免疫测定，将放射性核素的敏感性与抗原抗体结合的特异性结合起来，具有重复性好、准确性高的优点，广泛应用于激素、药物等微量物质的检测，敏感性可达pg/ml水平。免疫荧光技术是用来检测特异性抗原和抗体的方法（A错）。双向琼脂扩散（C错）用于检测可溶性抗原或抗体、对复杂的抗原或抗体成分进行纯度鉴定、稀释免疫血清进行血清的效价（半定量）测定等。单向琼脂扩散法（D错）可用于血清中免疫球蛋白的（IgG、IgA、IgM）、C3、AFP或其他可溶性抗原的定量测定。对流免疫电泳（E错）用于各种蛋白的定性和半定量测定。